47岁男性。上颌前牙固定修复3年，现出现松动，咬合疼痛。口腔检查：左上2缺失，左上123烤瓷固定桥修复，左上13为烤瓷全冠固位体，边缘均不密合。左上1远中和左上3的近中邻面可探及深龋，左上3叩诊（++），牙龈红肿，无牙周袋。余牙健康，咬合正常。治疗前最需做的辅助检查是
A. 基牙的X线检查
B. 基牙的牙髓活力检测
C. 基牙的松动度检查
D. 基牙的干扰检查
E. 以上均需做

正确答案：A。基牙的X线检查

解析：本题考查临床检查。常规X线片能确定牙根及牙周支持组织的健康状况，了解牙根的数目、形态及长度，有无根折，根管充填的情况。常常能够检查出牙邻面、牙颈部、牙根部等较为隐秘部位的龋坏，因此治疗前最需做的辅助检查是基牙的X线检查（A对）。该患者咬合疼痛，左上1远中和左上3的近中邻面可探及深龋，牙髓尚正常，暂且无需进行基牙的牙髓活力检测（B错）。左上3叩诊（++），牙龈红肿，无牙周袋，牙龈存在炎症，但尚未进展为牙周炎，无需进行基牙的松动度检查（C错）。